能活化补体经典途径的是
A. 荚膜
B. 外膜蛋白
C. 肺炎链球菌溶血素
D. 神经氨酸酶
E. 紫癜形成因子

正确答案：C。肺炎链球菌溶血素

解析：肺炎链球菌溶血素（肺炎链球菌主要致病物质）：可溶解人、马、羊和兔的红细胞，并能活化补体经典途径，引起发热、炎症及组织损伤。掌握“链球菌属”知识点。